锻造镍铬合金中铜的主要作用为
A. 抗腐蚀性
B. 使合金变软，有韧性
C. 增加合金的强度和硬度
D. 增加流动性，改善焊接性能
E. 以上均正确

正确答案：D。增加流动性，改善焊接性能

解析：本题考查锻造镍铬合金中铜的作用。铜元素能使合金增加流动性，改善焊接性能（D对）。抗腐蚀性（A错）是镍和铬元素在镍铬合金中的作用，使合金变软且有韧性（B错）是镍的主要作用，而增加合金的强度和硬度（C错）则是铬的作用。